患者，女，27岁，外阴瘙痒5天，妇科检查见阴道分泌物呈豆腐渣样，擦除后露出红肿黏膜面，诊断为阴道炎。宜选用的治疗方案是
A. 局部用克林霉素软膏
B. 局部用尼尔雌醇软膏
C. 局部用克霉唑栓
D. 局部用甲硝唑片
E. 口服莫西沙星片

正确答案：C。局部用克霉唑栓

解析：本题考查阴道炎用药。该患者可局部用克霉唑栓（C对）。外阴阴道假丝酵母菌病主要为外阴与阴道瘙痒、阴道分泌物增多，阴道分泌物的特征为白色稠厚，呈凝乳状或豆腐渣样。局部用药可选克霉唑制剂、咪康唑制剂、制霉菌素制剂。局部用克林霉素软膏（A错）用于革兰阳性菌所致感染。尼尔雌醇（B错）是口服长效雌激素，应用于雌激素缺乏引起的绝经期或更年期综合征。甲硝唑（D错）为硝基咪唑类衍生物，对滴虫、阿米巴和兰氏贾第鞭毛虫等原虫，以及脆弱拟杆菌等厌氧菌具强大抗菌活性，为治疗肠道和肠外阿米巴病、阴道滴虫病的首选药；亦广泛用于各种厌氧菌感染；口服也可用于艰难梭菌所致的假膜性肠炎、与其他药物联合用于幽门螺杆菌所致的胃窦炎及消化性溃疡；与其他抗菌药物联合使用也可作为盆腔、肠道、腹腔手术的预防用药。莫西沙星（E错）属于氟喹诺酮类抗菌药，用于治疗社区获得性肺炎。